某女，69岁。患糖尿病3年，服用消糖灵胶囊，血糖控制良好。半年前确诊为高血压病，加用珍菊降压片，服用1个月后，发现血糖控制不佳，其原因是珍菊降压片含有影响血糖的成分，该成分是
A. 枸橼酸钠
B. 氢氯噻嗪
C. 盐酸异丙嗪
D. 吲哚美辛
E. 盐酸苯海拉明

正确答案：B。氢氯噻嗪

解析：本题考查的是含西药组分的中成药。患糖尿病3年，服用消糖灵胶囊，血糖控制良好。半年前确诊为高血压病，加用珍菊降压片，服用1个月后，发现血糖控制不佳，其原因是珍菊降压片含有影响血糖的成分，该成分是氢氯噻嗪（B对）。珍菊降压片：功能降压。用于高血压。含西药成分盐酸可乐定、氢氯噻嗪。为枸橼酸钠（A错）的中成药有消痔灵注射液。消痔灵注射液：功能收敛，止血。用于内痔出血，各期内痔、静脉曲张性混合痔。含西药成分：鞣酸、三氯叔丁醇、低分子右旋糖酐注射液、枸橼酸钠、亚硫酸氢钠、甘油。为盐酸异丙嗪（C错）的中成药有咳喘膏。咳喘膏：功能止咳平喘，利湿祛痰。用于单纯性慢性支气管炎、喘息性慢性支气管炎、哮喘（除心脏引起的）等。含西药成分：盐酸异丙嗪。为吲哚美辛（D错）的中成药有新癀片。新癀片：功能清热解毒，活血化瘀，消肿止痛。用于热毒瘀血所致的咽喉肿痛、牙痛、痹痛、胁痛、黄疸、无名肿毒。含西药成分吲哚美辛。为盐酸苯海拉明（E错）的中成药有腰肾膏等。腰肾膏：功能温肾助阳，强筋壮骨。用于肾阳不足所致的腰膝酸痛、夜尿频数、遗精早泄、阳痿。含西药成分：水杨酸甲酯、盐酸苯海拉明。